细菌内毒素的特征是
A. 只有革兰阴性细菌产生
B. 少数革兰阳性细菌产生
C. 细菌在生活状态下释放
D. 抗原性强
E. 不耐热

正确答案：A。只有革兰阴性细菌产生

解析：本题考查细菌内毒素。细菌内毒素的特征是只有革兰阴性细菌产生（A对）。内毒素是革兰氏阴性菌细胞壁的外膜成分脂多糖（LPS），在细菌裂解时释放，故只有革兰氏阴性菌能产生内毒素；革兰氏阳性菌和少数革兰氏阴性菌在活菌状态能分泌的外毒素，其特征为抗原性强且不耐热。细菌内毒素来源于：革兰阴性细菌（A对B错）；释放方式：死亡裂解释放（C错）；化学成分：脂多糖；毒性作用：较弱，引起发热等全身反应；稳定性：耐热（E错），160度，2-4小时才被破坏；抗原性弱（D错），甲醛处理不形成类毒素。